下列有关生存率估计的描述中不正确的是
A. 乘积极限法和寿命表法均利用概率乘法定理来计算生存率
B. 乘积极限法可以适用于小样本资料
C. 寿命表法可以适用于频数表形式的生存分析资料
D. 乘积极限法是一种参数方法

正确答案：D。乘积极限法是一种参数方法

解析：本题考查生存率的相关描述。乘积极限法和寿命表法均利用概率乘法定理来计算生存率（A对）；乘积极限法可以适用于小样本资料（B对）；寿命表法可以适用于频数表形式的生存分析资料（C对）；乘积极限法是一种非参数检验的方法（D错，为本题正确答案）。